某女，43岁。患乳腺增生病，症见双侧乳房疼痛并出现肿块，月经前加重，经后缓解，乳房肿块大小不一、边界不清，时伴胸闷胁胀，善郁易怒，月经失调，心烦口苦。宜选用的中成药是
A. 牛黄化毒片
B. 乳康片
C. 乳疾灵颗粒
D. 乳增宁胶囊
E. 乳癖消胶囊

正确答案：D。乳增宁胶囊

解析：本题考查的是乳癖的辨证论治。某女，43岁。患乳腺增生病，症见双侧乳房疼痛并出现肿块，月经前加重，经后缓解，乳房肿块大小不一、边界不清，时伴胸闷胁胀，善郁易怒，月经失调，心烦口苦。宜选用的中成药是乳增宁胶囊（D对）。乳癖，是乳腺组织的既非炎症也非肿瘤的良性增生性疾病。临床特点是单侧或双侧乳房疼痛并出现肿块，乳痛和肿块与月经周期及情志变化密切相关。乳房肿块大小不等，形态不一，边界不清，质地不硬，活动度好。常见于中青年妇女，是临床最常见的乳房疾病。西医学的乳腺小叶增生、乳房囊性增生等疾病表现为上述症状者，可参考此内容辨证论治。（一）肝郁痰凝证：【症状】多见于青壮年妇女。乳房肿块，质韧不坚，胀痛或刺痛，症状常随喜怒消长；伴胸闷胁胀，善郁易怒，失眠多梦，心烦口苦。舌苔薄黄，脉弦滑。【中成药应用】常用中成药有乳核散结片、乳疾灵颗粒（C错）、乳康片（B错）。（二）冲任失调证：【症状】多见于中年妇女。乳房肿块月经前加重，经后缓解；伴腰膝酸软，神疲倦怠，月经失调，量少色淡，或闭经。舌质淡，苔白，脉沉细。【中成药应用】常用中成药有乳增宁胶囊。牛黄化毒片（A错）为乳痈热毒炽盛证的中成药应用。乳痈热毒炽盛证：【症状】乳房肿痛加剧，皮肤焮红灼热，继之肿块变软，有应指感；或溃后脓出不畅，红肿热痛不消，有“传囊”现象；伴壮热不退，口渴喜饮，便秘溲赤。舌质红，苔黄腻，脉洪数。【中成药应用】常用中成药有牛黄化毒片、九一散。乳癖消胶囊（E错）：【功能】软坚散结，活血消痈，清热解毒。【主治】痰热互结所致的乳癖、乳痈，症见乳房结节、数目不等、大小形态不一、质地柔软，或产后乳房结块、红热疼痛；乳腺增生、乳腺炎早期见上述证候者。